诊断乙型肝炎的直接证据是
A. HBsAg
B. HBcAg
C. HBV-DNA
D. HBeAg
E. 抗-HBs

正确答案：C。HBV-DNA

解析：本题考查的是乙肝病毒DNA。诊断乙型肝炎的直接证据是HBV-DNA（C对）。乙型肝炎病毒DNA（HBV-DNA）是诊断乙型肝炎的直接证据，比血清免疫学检查更灵敏，特异性更强。乙型肝炎病毒（HBV）是乙型肝炎的病原体，属嗜肝DNA病毒。其标志物包括6项：乙型肝炎病毒表面抗原与抗体（HBsAg与抗-HBs）、乙型肝炎病毒核心抗原与抗体（HBcAg与抗-HBc）以及乙型肝炎病毒e抗原与抗体（HBeAg与抗-HBe）。HBV标志物检测对HBV的感染和复制，肝炎的诊断、鉴别、转归及预后，以及治疗效果判断均有重要价值。HBsAg（A错）与抗-HBs（E错）：HBsAg是HBV感染最早期（1～2个月）血清里出现的一种特异性标志物，可维持数周至数年，甚至终身；HBsAg可从乙型肝炎患者的体液和分泌物中测出，阳性有临床意义。抗-HBs是人体针对HBsAg产生的中和抗体，一般在感染后3～6个月才出现，是一种保护性抗体，表明人体对HBV具有一定的免疫力。HBcAg（B错）与抗-HBc：HBcAg主要存在于受感染的肝细胞内，血液中游离的HBcAg极少，故较少用于临床常规检测。抗-HBc不是中和抗体，而是反映肝细胞受到HBV侵害的可靠指标，主要有IgM和IgG两型：抗HBc-IgM是机体感染HBV后在血液中最早出现的特异性抗体，故常作为急性HBV感染的指标；抗HBc-IgG出现较晚，其阳性可持续多年，甚至终身，具有流行病学意义。HBeAg（D错）与抗-HBe：HBeAg位于HBV病毒颗粒的核心部分，是HBV复制的指标之一。抗-HBe是HBeA的对应性抗体，不是保护性抗体，不能抑制HBV的复制。